上唇部疖或痈的主要危险是导致
A. 颈部蜂窝织炎
B. 大脑脓肿
C. 眼球感染
D. 上颌骨骨髓炎
E. 海绵窦静脉炎

正确答案：E。海绵窦静脉炎

解析：上唇部疖或痈，如果遭受到挤压，病原菌可经过内眦静脉、眼静脉（面部静脉无静脉瓣）进入颅内海绵状静脉窦，引起化脓性海绵状静脉窦炎（E对），可有寒战、高热、头痛、呕吐、昏迷甚至死亡，病情严重，死亡率极高。颈部蜂窝织炎（A错）的炎症可通过皮肤或软组织损伤后感染引起，也可通过局部化脓性感染灶直接扩散或经淋巴、血液传播引起，常见由口腔、咽喉等急性炎症引起。大脑脓肿（B错）可由中耳炎、乳突炎、鼻窦炎、颅骨骨髓炎及颅内静脉窦炎等化脓性感染病灶可直接向脑内蔓延，形成脑脓肿；亦可为血源性或外伤性。眼球感染（C错）多因眼球穿通伤，内眼手术后，化脓性角膜炎引起。上颌骨骨髓炎（D错）可为牙源性、损伤性及血源性。颈部蜂窝织炎、大脑脓肿、眼球感染、上颌骨骨髓炎只要处理及时均可治愈，死亡率远远低于海绵窦静脉炎，均不是由上唇部疖或痈导致的主要危险。